能够增强靶组织对胰岛素敏感性的药是
A. 阿卡波糖
B. 二甲双胍
C. 格列喹酮
D. 罗格列酮
E. 格列齐特

正确答案：D。罗格列酮

解析：本题考查罗格列酮。罗格列酮（D对）是噻唑烷二酮类胰岛素增敏剂，通过增加骨骼肌、肝组织、脂肪组织对胰岛素的敏感性，提高细胞对葡萄糖的利用而发挥降低血糖的疗效。阿卡波糖（A错）是葡萄糖苷酶抑制剂。二甲双胍（B错）通过促进组织对葡萄糖的摄取和利用，抑制葡萄糖在肠道的吸收，降低血糖。格列喹酮（C错）、格列齐特（E错）是磺酰脲类口服降糖药，可以刺激胰岛B细胞释放胰岛素。